心室肌细胞兴奋性的特点是
A. 有效不应期长
B. 相对不应期长
C. 超常期长
D. 低常期长
E. 局部反应期长

正确答案：A。有效不应期长